再生障碍性贫血的主要原因是
A. 骨髓造血功能衰竭
B. 红细胞破坏过多
C. C红细胞寿命缩短
D. 造血原料缺乏
E. 红细胞内在缺陷

正确答案：A。骨髓造血功能衰竭

解析：再生障碍性贫血是由骨髓造血功能衰竭（A对）引起的贫血。红细胞破坏过多（P537）（B错）引起的贫血即溶血性贫血，红细胞寿命缩短（P551）（C错）、红细胞内在缺陷（P551）（E错）是溶血性贫血常见的病因；造血原料缺乏（P537）（D错）是巨幼细胞贫血和缺铁性贫血常见的病因。